通过牙周探诊显示最有意义的指标是
A. 牙周袋的深度
B. 探及龈下牙石
C. 袋内溢脓
D. 附着水平
E. 探诊出血

正确答案：D。附着水平

解析：本题考查牙周疾病促进因素。通过牙周探诊显示最有意义的指标是附着水平（D对）。牙周探诊是牙周炎诊断中最重要的检查方法。主要目的是了解有无牙周袋或附着丧失，并探测其深度和附着水平，此外，还应观察探诊后是否出血，探测龈下牙石的量及分布，根分叉是否受累。